对新生儿进行乙肝疫苗接种，评价疫苗效果时最好选用的指标
A. 有效率、副反应发生率
B. 相对危险度、特异危险度
C. 发病率、患病率、死亡率
D. 保护率、效果指数
E. 爆发率、流行率

正确答案：D。保护率、效果指数

解析：本题考查评价预防措施效果的主要指标。评价预防措施效果的主要指标包括：保护率和效果指数（D对ABCE错）。